当双端固定桥两端固位力不相等时会引起
A. 基牙松动
B. 基牙下沉
C. 固位体磨耗
D. 固位体松动、脱落
E. 固位体变形

正确答案：D。固位体松动、脱落

解析：若基牙受力过大，超过所能承受的负荷，引起牙周支持组织的损伤，牙槽骨的吸收，才会引起基牙的松动。多由于设计不合理所致。而两端固位力不相等则会形成转动中心，造成固定桥松动。掌握“固定桥的组成和分类”知识点。